MΦ产生的能活化T细胞的是
A. IL-1
B. IL-2
C. IL-8
D. IL-5
E. IL-6

正确答案：A。IL-1